尿道损伤合并尿外渗及阴囊血肿时，有效的治疗方法是
A. 导尿
B. 经会阴尿道吻合＋消除血肿及尿外渗
C. 清除会阴部血肿
D. 耻骨上膀胱造瘘
E. 经会阴尿道修补

正确答案：B。经会阴尿道吻合＋消除血肿及尿外渗

解析：球部远端和阴茎部的尿道完全性断裂，阴囊内会形成大血肿，血肿压迫导致尿潴留，用力排尿则发生尿外渗，如不及时处理或处理不当可发生广泛皮下组织坏死、感染及脓毒症，应及时经会阴消除血肿及尿外渗，然后行尿道吻合（B对），条件不允许时可仅做耻骨上膀胱造瘘（D错）。